下列关于颗粒细胞型成釉细胞瘤叙述，不正确的是
A. 颗粒细胞大
B. 胞质丰富，充满嗜酸性颗粒
C. 细胞呈立方状、柱状或圆形
D. 肿瘤内出现广泛角化
E. 颗粒细胞可部分或全部取代肿瘤的星网状细胞

正确答案：D。肿瘤内出现广泛角化

解析：颗粒细胞型：肿瘤上皮细胞有时还可发生颗粒样变性，颗粒细胞可部分或全部取代肿瘤的星网状细胞。颗粒细胞大，呈立方状、柱状或圆形。其胞质丰富，充满嗜酸性颗粒，在超微结构和组化方面类似于溶酶体。掌握“成釉细胞瘤”知识点。